蛋白质生物学价值的高低主要取决于
A. 真消化率
B. 表观消化率
C. 含量
D. 所含氨基酸的数量
E. 所含必需氨基酸的含量和比值

正确答案：E。所含必需氨基酸的含量和比值

解析：食物蛋白质中必需氨基酸的含量和比值越接近人体的需要（预防医学第三版P61），其生物学价值越高（E对CD错）。蛋白质消化率是指蛋白质被消化酶分解的程度（预防医学第三版P60）。消化率高表明该蛋白质被利用的可能性大，其营养价值也高（AB错）。蛋白质消化率可分为真消化率和表观消化率。真消化率=[摄入氮-（粪氮-粪内氮源）]/摄入氮×100%。表观消化率=（摄入氮-粪氮）/摄入氮×100%。